毛果芸香碱可作用于
A. α₁受体
B. α₂受体
C. β₁受体
D. β₂受体
E. M受体

正确答案：E。M受体

解析：本题考查毛果芸香碱。毛果芸香碱能够选择性兴奋M胆碱受体（E对），发挥M样作用。表现为：（1）心血管功能抑制；（2）平滑肌收缩；（3）瞳孔括约肌和睫状肌收缩，瞳孔缩小 ；（4）促进唾液腺、汗腺、泪腺和消化道等腺体的分泌。α₁受体（A错）主要分布在血管平滑肌，激动时引起血管收缩。α₂受体（B错）主要分布在去甲肾上腺素能神经的突触前膜上，受体激动时可使去甲肾上腺素释放减少。β₁受体（C错）主要分布于心脏，可增加心肌收缩性，自律性和传导功能。β₂受体（D错）主要分布在支气管平滑肌，血管平滑肌和心肌。